糖尿病的病因之一是
A. 大肠杆菌
B. 胰岛素分泌不足
C. 幽门螺杆菌
D. 消化道痉挛
E. 白色念珠菌

正确答案：B。胰岛素分泌不足

解析：本题考查糖尿病的病因。胰岛素分泌不足（B对）导致碳水化合物、脂肪和蛋白质的代谢失衡和慢性高血糖，是糖尿病的病因之一。大肠杆菌感染（A错）可导致轻度急性腹泻、结膜炎等。幽门螺旋杆菌感染（C错）导致消化性溃疡。消化道痉挛（D错）导致便秘。白色念珠菌（E错）会诱发真菌性阴道炎。